堆肥法的原理是
A. 人畜粪便、垃圾在适宜条件下和微生物作用形成腐殖质
B. 人畜粪便在有氧条件下发生化学分解达到无机化
C. 人畜粪便、垃圾在密封容器中氧化分解，达到无害化
D. 人畜粪便、有机垃圾在密封容器中氧化分解，然后又在厌氧菌作用下发酵腐熟
E. 以上都不是

正确答案：A。人畜粪便、垃圾在适宜条件下和微生物作用形成腐殖质

解析：本题考查堆肥法的原理。堆肥法的原理是人畜粪便、垃圾在适宜条件下和微生物作用形成腐殖质（A对BCDE错）。这种腐殖质可以作为有机肥料，从而改善土壤的肥力，提高作物的产量。